可增强心肌收缩力的药物
A. 辛伐他汀
B. 多巴酚丁胺
C. 二者均是
D. 二者均不是

正确答案：B。多巴酚丁胺